零级反应有效期计算公式是
A. 1gC=（-k/2.303）t+lgC₀
B. t₀.₉=C₀/10k
C. C-C₀=-kt
D. t₀.₉=0.1054／k
E. t1/2=0.693/k

正确答案：B。t₀.₉=C₀/10k